古代的本草典籍有
A. 《黄帝内经》
B. 《本草纲目》
C. 《中华本草》
D. 《神农本草经》
E. 《本草经集注》

正确答案：B、D、E。《本草纲目》；《神农本草经》；《本草经集注》

解析：本题考查的是古代的本草典籍。古代的本草典籍有《本草纲目》（B对）、《神农本草经》（D对）与《本草经集注》（E对）。主要古代本草典籍有《神农本草经》、《本草经集注》、《重修政和经史证类备急本草》、《本草纲目》等。《黄帝内经》（A错）属于古代主要医学典籍。古代主要医学典籍有《黄帝内经》、《伤寒论》、《金匮要略方论》、《巢氏诸病源候论》、《温疫论》等。《中华本草（C错）为当代所著。